臭氧层位于大气垂直结构哪一层内
A. 对流层
B. 平流层
C. 中间层
D. 热层
E. 外大气层

正确答案：B。平流层

解析：本题考查臭氧层的位置。臭氧层是大气层结构中一种特殊的层，它位于地球大气层的平流层（B对ACDE错）内，紧贴在对流层上方，是大气层中最重要的一层。臭氧层能吸收太阳的短波紫外线和宇宙射线，使地球上的生物免受这些射线的危害，能够生存繁衍。